患者，女，27岁，已婚。月经周期提前量多，色淡，质稀，神疲乏力，小腹空坠，纳少便溏。其证候是
A. 气虚
B. 血虚
C. 血热
D. 湿热
E. 血瘀

正确答案：A。气虚

解析：题中患者月经周期提前量多，故诊断为月经先期。气虚统摄无权，故冲任不固，而致月经周期提前且量多，气虚火衰，血失温煦，故经色淡、质稀，气虚则脏腑功能减退，故神疲乏力，气虚无力升举，故小腹空坠，气虚致脾运化失职，故纳少便溏。故辨为气虚证（A对）。血虚多伴面色淡白或萎黄，经量减少，经期延长等症状（B错）。血热经色多深红或紫红，质黏稠，兼有热象（C错）。湿热多有身热、口苦、胸闷脘痞、小便黄等症状（D错）。血瘀经血多色黯，有血块，且血瘀不导致月经先期（E错）。